女，20岁。头痛2年，呈发作性双颞部剧烈头痛，与月经有明显关系，发作后，常有疲劳，倦怠，无力，食欲差。该患者预防治疗应选择的药物是
A. 苯妥英钠
B. 卡马西平
C. 丙戊酸钠
D. 苯巴比妥
E. 托吡酯

正确答案：E。托吡酯

解析：患者为年轻女性，有头痛家族史，发病时间(月经期）及疼痛部位(双颞部）发作后有偏头痛后期表现(疲劳，倦怠，无力，食欲差），符合偏头痛的特征，首先考虑诊断偏头痛。其疼痛呈发作性，已持续2年，应按慢性偏头痛诊疗。预防再发使用的药物包括:肾上腺素能受体阻滞剂､钙离子拮抗剂､抗癫痫药(如托吡酯及丙戊酸钠）､抗抑郁药､5-HT受体拮抗剂。托吡酯及丙戊酸钠均可用于预防头痛发作，丙戊酸钠(C错）也可以用于预防头痛发作，但由于用药量较大，每日使用次数较多，不作为首选药物，故本题最佳答案为托吡酯(E对）。苯妥英钠(A错）､卡马西平(B错）､苯巴比妥(D错）均有镇静催眠的作用，可用于治疗癫痫，由于反应强烈，较少作为预防用药。